药品零售药店对乙类非处方药可采用
A. 分柜摆放销售方式
B. 有奖销售方式
C. 开架自选销售方式
D. 附赠药品销售方式
E. 凭执业医师处方销售方式

正确答案：C。开架自选销售方式

解析：本题考查药店零售管理。药品零售药店对乙类非处方药可采用开架自选销售方式（C对）。《处方药与非处方药流通管理暂行规定》第三章药店零售第十条：处方药必须凭执业医师或执业助理医师处方销售、购买和使用（E错）。执业药师或药师必须对医师处方进行审核、签字后依据处方正确调配、销售药品。对处方不得擅自更改或代用。对有配伍禁忌或超剂量的处方，应当拒绝调配、销售，必要时，经处方医师更正或重新签字，方可调配、销售。零售药店对处方必须留存2年以上备查。第十一条：处方药不得采用开架自选销售方式。第十三条：处方药、非处方药应当分柜摆放（A错）。第十四条：处方药、非处方药不得采用有奖销售（B错）、附赠药品（D错）或礼品销售等销售方式，暂不允许采用网上销售方式。